Q-T间期延长的荨麻疹患者不宜选用的抗过敏药是
A. 氯苯那敏
B. 色甘酸钠
C. 苯海拉明
D. 异丙嗪
E. 依巴斯汀

正确答案：E。依巴斯汀

解析：本题考查荨麻疹治疗药。Q-T间期延长的荨麻疹患者不宜选用的抗过敏药是依巴斯汀（E错，为本题正确答案）。依巴斯汀可能抑制心脏钾离子慢通道，有引起尖端扭转型室性心动过速或Q-T间期延长的危险。治疗荨麻疹常用的抗过敏药有异丙嗪（D对）、氯苯那敏（A对）、苯海拉明（C对）、去氯羟嗪、赛庚啶；过敏活性物质阻释剂有色甘酸钠（B对）、酮替芬。